选用于缓慢型心律失常的药物是
A. 樟柳碱
B. 山莨菪碱
C. 阿托品
D. 新斯的明
E. 东莨菪碱

正确答案：C。阿托品

解析：阿托品临床可用于治疗迷走神经过度兴奋所致窦房阻滞、房室阻滞等缓慢型心律失常（C对），也用于窦房结功能低下而出现的室性异位节律。樟柳碱应用于血管神经头痛、脑血管疾病引起的急性瘫痪、震颤麻痹、支气管哮喘、晕动病、有机磷农药中毒等（A错）。山莨菪碱代替阿托品用于胃肠绞痛、各种感染中毒性休克（B错）。新斯的明应用于重症肌无力、术后腹气胀及尿潴留、阵发性室上性心动过速、肌松药过量的解救（D错）。东莨菪碱用于晕车晕船，也可用于妊娠或放射病所致呕吐，此外还用于帕金森病（E错）。